以下对常用儿童行为指导方法的描述中，不正确的是
A. 以逐步消除紧张、焦虑、恐怖等情绪反应为目的的“系统脱敏法”
B. 以奖励方式鼓励出现期望行为方式为主的“正性强化法”
C. 以帮助摆脱某种不愉快刺激，促使良好行为出现频率增加为主的“负性强化法”
D. 通过逐步增加进入个体大脑的视、听、触等感觉刺激信息，促使中枢神经系统形成有效组合的“感觉统合训练法"
E. 以确定靶目标为主制订的行为矫治法

正确答案：E。以确定靶目标为主制订的行为矫治法